下列除哪项外，均为细辛的功效
A. 解表散寒
B. 祛风止痛
C. 燥湿止带
D. 宣通鼻窍
E. 温肺化饮

正确答案：C。燥湿止带

解析：细辛的功效是解表散寒，祛风止痛，通窍，温肺化饮而不具有燥湿止带的功效（C对），可用于治疗风寒感冒，头痛，牙痛，风湿痹痛，鼻渊，肺寒咳喘。